婴幼儿配方乳粉的产品配方应当
A. 报省级食品监督管理部门备案
B. 经省级食品监督管理部门注册
C. 报国务院食品安全监督管理部门备案
D. 经国务院市场监督管理部门注册

正确答案：D。经国务院市场监督管理部门注册

解析：本题考查特殊医学用途配方食品和婴幼儿配方食品的管理。婴幼儿配方乳粉的产品配方应当经国务院市场监督管理部门注册（D对）。婴幼儿配方乳粉产品配方，是指生产婴幼儿配方乳粉使用的食品原料、食品添加剂及其使用量，以及产品中营养成分的含量。婴幼儿配方食品生产企业应当将食品原料、食品添加剂、产品配方及标签等事项向省（区、市）人民政府市场监督管理部门备案。婴幼儿配方乳粉产品配方应当经国务院市场监督管理部门注册批准。保健食品，是指声称具有特定保健功能或者以补充维生素、矿物质为目的的食品。即适宜于特定人群食用，具有调节机体功能，不以治疗疾病为目的，并且对人体不产生任何急性、亚急性或者慢性危害的食品。使用保健食品原料目录以外原料的保健食品和首次进口的保健食品应当经国务院食品安全监督管理部门注册。首次进口的保健食品中属于补充维生素、矿物质等营养物质的，应当报国务院食品安全监督管理部门备案（C错）。其他保健食品应当报省、自治区、直辖市人民政府食品安全监督管理部门备案（A错）。进口的保健食品应当是出口国（地区）主管部门准许上市销售的产品。